医院污水的特征是
A. 含氮、磷等元素
B. 含多种病毒、病菌和寄生虫卵
C. 含农药成分
D. 水质和水量差别很大
E. 含重金属

正确答案：B。含多种病毒、病菌和寄生虫卵

解析：本题考查医院污水的特征。医院污水的特征是含多种病毒、病菌和寄生虫卵（B对ACDE错）。